毒理学研究外源化学物和内源化学物对机体的
A. 营养作用
B. 治疗作用
C. 有害作用
D. 有益作用

正确答案：C。有害作用

解析：本题考查毒理学研究。毒理学研究外源化学物和内源化学物对机体的有害作用（C对ABD错）。